RPD三种支持形式中，哪一项是错误的
A. 主要由天然牙来承担的称牙支持式
B. 牙支持式多用于缺牙数目不多而基牙健康者
C. 黏膜支持式义齿多用三臂卡增加固位，减轻黏膜负担
D. 混合支持式义齿尤其适用于游离缺失的牙列缺损
E. 混合支持式义齿是由天然牙和黏膜共同承担（牙合）力

正确答案：C。黏膜支持式义齿多用三臂卡增加固位，减轻黏膜负担

解析：本题考查可摘局部义齿的类型及支持方式。RPD（可摘局部义齿）按义齿对所承受力的支持方式可分为三类：牙支持式义齿，黏膜支持式义齿，混合支持式义齿。黏膜支持式义齿主要由黏膜以及其下的槽骨负担（C错，为本题的正确答案）增加了黏膜及牙槽骨负担，不用三臂卡增加固位，且卡环不设置（牙合）支托。义齿所承受的力主要由天然牙来承担的称牙支持式义齿（A对）。牙支持式义齿多用于缺牙数目不多而基牙健康者（B对），可增加义齿的稳固，减少黏膜的负担。混合支持式义齿指义齿承受的力由天然牙和黏膜、牙槽嵴共同承担（E对），适应于各类牙列缺损，适用于游离缺失的牙列缺损（D对）。